行左下第一磨牙种植术，下列成功的标准中，除外
A. 功能好
B. 无麻木，疼痛
C. 自我感觉良好
D. 无与种植体相关的感染
E. 横行骨吸收不超过2/3

正确答案：E。横行骨吸收不超过2/3

解析：本题考查牙种植手术及效果评估。1995年中华口腔医学会杂志社在珠海制定的种植成功标准为：①功能好（A对）；②无麻木，疼痛（B对）等不适；③自我感觉良好（C对）；④种植体周围X线无透射区；横行骨吸收不超过1/3（E错，为本题正确答案），种植体不松动；⑤龈炎可控制；⑥无与种植体相关的感染（D对）；⑦对邻牙支持组织无损害；⑧美观；⑨咀嚼效率大于70%；⑩符合上述要求者5年成功率应达到85%以上；10年80%以上。